男性，18岁，自幼有哮喘，每年春季发作，用沙丁胺醇可缓解。今在公园春游时突感胸闷气急。除了考虑哮喘急性发作外，应主要鉴别的疾病是
A. 急性支气管炎
B. 自发性气胸
C. 外源性变态反应肺泡炎
D. 急性心功能不全
E. 肺栓塞

正确答案：B。自发性气胸